1～6岁小儿体重为
A. [年龄（月）+9]/2
B. 年龄（岁）×2+8
C. 年龄（岁）×7-5
D. 年龄（岁）×6+7
E. 年龄（岁）×5+9

正确答案：B。年龄（岁）×2+8

解析：小儿2岁至青春前期体重增长减慢，年增长值约2kg。1～6岁小儿体重计算公式为：年龄（岁）×2+8（B对）。